下列何器官不属于后纵隔
A. 食管
B. 支气管
C. 奇静脉
D. 胸导管
E. 胸腺

正确答案：E。胸腺

解析：后纵隔容纳气管杈及左、右主支气管（B对）、食管（A对）、胸主动脉、奇静脉（C对）、半奇静脉、胸导管（D对）、交感干胸段和淋巴结等（E错，为本题正确答案）。